男性，急性乐果重度中毒72小时后出现肌力明显减低，此时应考虑
A. 有机磷农药急性中毒神经系统后遗症
B. 胆碱能危象
C. 有机磷农药中毒中间肌无力综合征
D. 亚急性中毒
E. 中毒性周围神经病

正确答案：C。有机磷农药中毒中间肌无力综合征